下列各项中，属于实证临床表现的是
A. 二便不通
B. 二便失禁
C. 自汗
D. 盗汗
E. 疼痛隐隐

正确答案：A。二便不通

解析：外感疾病的实证常见恶寒，壮热，狂躁，声高气粗，腹痛拒按，二便不通，脉实有力等表现（A对）；二便失禁、自汗、盗汗、疼痛隐隐均为虚证的临床表现（BCDE错）。